蜂蜜的化学成分主要有
A. 糖类
B. 酶类
C. 甾醇类
D. 挥发油
E. 生物碱

正确答案：A、B、D。糖类；酶类；挥发油

解析：本题考查的是蜂蜜的成分。蜂蜜的化学成分主要有糖类（A对）、酶类（B对）、挥发油（D对）。蜂蜜【成分】主含葡萄糖及果糖约70%，两者含量相近，“油性大”、质量好的蜂蜜果糖含量较高。另含少量蔗糖、有机酸、挥发油、维生素（B₁、B₂、B₃、B₆、C、A、D、E、K、H等）、酶类（转化酶、淀粉酶、葡萄糖氧化酶、过氧化氢酶、酯酶等）、乙酰胆碱、无机元素（镁、硫、磷、钙、钾、钠、碘等）及花粉、蜡质等。另含多酚类及黄酮类。浙贝母【成分】含甾醇类（C错）生物碱（E错），主要为贝母素甲、贝母素乙、浙贝宁、浙贝丙素、浙贝酮、贝母辛、异浙贝母素甲等多种生物碱。